易出现多环芳烃污染的肉制品是
A. 腌肉
B. 熏肉
C. 酱肉
D. 咸肉
E. 卤肉

正确答案：B。熏肉

解析：本题考查易出现多环芳烃污染的肉制品。在制作熏肉（B对ACDE错）、火腿、香肠及腊肉时，易出现多环芳烃污染。